不属于细菌的生长曲线时期的是
A. 迟缓期
B. 加速期
C. 对数期
D. 稳定期
E. 衰亡期

正确答案：B。加速期